釉质生长线和横纹明显，孔隙增大的是
A. 脱矿层
B. 细菌侵入层
C. 暗层
D. 病损体部
E. 透明层

正确答案：D。病损体部

解析：本题考查牙釉质龋。釉质生长线和横纹明显，孔隙增大的是病损体部（D对）。病损体部：是牙釉质龋病变的主要部分，从表层下一直延伸到近暗层。在偏振光下病损体部呈正双折射。脱矿层（A错）：位于透明层表面，是在细菌侵入之前，酸的扩散所导致的脱矿改变。此层牙本质小管形态仍然比较完整，牙本质小管内基本上无细菌侵入。细菌侵入层（B错）：牙本质小管扩张，管壁脱矿，形成坏死灶。暗层（C错）：紧接于透明层表面，偏光显微镜观察，暗层呈正双折射，同时存在脱矿与再矿化的区域，在快速进展的病变暗层较窄，而在缓慢进展的病变由于发生了较多的再矿化因而暗层较宽。透明层（E错）：又称硬化层，为牙本质龋最深层、最早出现的改变，位于病变的底部和侧面，在透射光下呈均质透明状，这种透明是由于牙本质小管管腔变窄、管腔中有矿物盐沉积，使管腔内折光率与周围细胞间质相似。